患者，男，28岁，外出进餐后出现腹泻日6次，水样便，无发热和腹痛症状。宜选用的药物是
A. 复方阿嗪米特肠溶片
B. 奥美拉唑肠溶胶囊
C. 蒙脱石散
D. 干酵母片
E. 诺氟沙星胶囊

正确答案：C。蒙脱石散

解析：本题考查蒙脱石散。该患者宜选用的药物是蒙脱石散（C对）。因化学刺激引起的腹泻，可供选用的有双八面体蒙脱石散，其可覆盖肠道，与黏膜蛋白结合后增强黏液屏障，防止酸、病毒、细菌、毒素对消化道黏膜的侵害。复方阿嗪米特肠溶片（A错）用于因胆汁分泌不足或消化酶缺乏而引起的症状。奥美拉唑肠溶胶囊（B错）用于胃溃疡、十二指肠溃疡、应激性溃疡、反流性食管炎和卓-艾综合征（胃泌素瘤）。干酵母片（D错）用于营养不良、消化不良、食欲不振及B族维生素缺乏症。诺氟沙星胶囊（E错）用于敏感菌所致的尿路感染、淋病、前列腺炎、肠道感染和伤寒及其他沙门菌感染。